对脾脏肿大与腹腔肿块的鉴别，最有意义的是
A. 质地
B. 活动度
C. 有无压痛
D. 有无切迹
E. 叩诊音的差异

正确答案：D。有无切迹

解析：对脾脏肿大与腹腔肿块的鉴别，最有意义的是有无切迹（D对）。